女，33岁。胃溃疡穿孔保守治疗24小时，拟行手术治疗。1年前因为溃疡穿孔行修补术。其手术过程中处理错误的是
A. 从原切口进入
B. 全身麻醉
C. 胃大部切除术
D. 甲硝唑及生理盐水灌洗腹腔至清洁
E. 放置腹腔引流管

正确答案：C。胃大部切除术

解析：青年女性患者，胃溃疡穿孔经保守治疗24小时后拟行手术治疗，提示患者病情加重，对于穿孔时间较长，腹腔污染严重者，只能行穿孔修补术，而不宜行胃大部切除术（C错，为本题正确答案）。曾做过腹部手术者，可经原切口或在其附近作切口以减小创伤（A对）；手术时多采用全身麻醉（B对）或硬膜外麻醉，个别休克危重患者也可用局部麻醉；胃大部切除术适用于穿孔时间不超过24小时、腹腔污染不重的患者；为减轻腹腔感染和防止术后发生腹腔脓肿，应彻底清洁腹腔，可用甲硝唑及生理盐水灌洗腹腔至清洁（D对），并放置腹腔引流管（E对）以充分引流。